以下药物选择的含量测定方法为:硫酸亚铁
A. 中和滴定法
B. 硫酸铈滴定法
C. 非水溶液滴定法
D. 络合滴定法
E. 高锰酸钾滴定法

正确答案：E。高锰酸钾滴定法